在治疗缺血性休克时，45min之内输入的等渗盐水的量为
A. 500～1000ml
B. 2000～3000ml
C. 100～300ml
D. 300～500ml
E. 1000～2000ml

正确答案：E。1000～2000ml

解析：在失血性休克中，补充血容量时，应快速滴注等渗盐水或平衡盐溶液,45分钟内输入1000～2000ml。掌握“休克”知识点。